患者因龋坏充填治疗后1年，牙齿折裂，要求治疗。查：右下6远中邻（牙合）面银汞充填体，近远中牙冠纵向劈裂达根部，下面哪项不是造成牙冠劈裂的原因
A. 洞壁有悬釉
B. 剩余牙体组织过少
C. 咬合创伤
D. 充填体过大
E. 充填材料选择不当

正确答案：E。充填材料选择不当

解析：本题考查牙齿折裂的常见原因。患者因龋坏充填治疗后1年，牙齿折裂，要求治疗。查：右下6远中邻（牙合）面银汞充填体，近远中牙冠纵向劈裂达根部，充填材料选择不当（E错，为本题的正确答案）不是造成牙冠劈裂的原因。充填材料选择不当可对牙髓造成化学性刺激，引起牙髓慢性炎症。牙齿折裂常见原因包括：窝洞制备时存在无基釉，薄壁弱尖未降低咬合，特别是在承受咬合力大的部位；磨除过多牙体组织，消弱了牙体组织的抗力；窝洞的点、线角太锐，导致应力集中；充填体过高、过陡、引起（牙合）创伤；充填材料过多膨胀，如银汞合金在固化过程中与水接触所造成的延缓性膨胀。窝洞制备时洞壁有悬釉，悬釉的抗力较低，不能承受较大咬合力，使用一段时间后容易发生折裂（A对）。牙体组织的抗力主要由剩余牙体组织和充填体提供，当充填体过大时，剩余牙体组织过少，容易使牙齿因抗力不足而发生折裂（BD对）。咬合创伤处的充填体及牙齿因受到较大的（牙合）力而容易发生折裂（C对）。